前伸（牙合）时上后牙尖的工作斜面是
A. 上牙舌尖的远中斜面
B. 上牙颊尖的舌斜面
C. 上牙舌尖的颊斜面
D. 上牙颊舌尖的颊斜面
E. 上牙颊尖的近中斜面

正确答案：A。上牙舌尖的远中斜面

解析：前伸（牙合）时上颌后牙的工作斜面为上颌后牙舌尖的远中斜面与下颌后牙颊尖的近中斜面。掌握“全口义齿初戴”知识点。